用两种方法检查已确诊的乳腺癌患者120名，甲法检出率为60％，乙法检出率为50％，两法一致的检出率为35％，欲比较两法检出率是否一致应选
A. 行×列表χ²检验
B. 四格表χ²检验
C. 配对计数资料χ²检验
D. 秩和检验
E. Z检验

正确答案：C。配对计数资料χ²检验